某卫生行政部门对其辖区内甲、乙两民营医院医疗技术人员的业务素质进行考核，在甲医院随机抽取100人，80人考核结果为合格，20人不合格；乙医院随机抽取150人，100人考核结果为合格，50人不合格。该研究资料类型分别为
A. 连续型定量资料
B. 离散型定量资料
C. 二分类资料
D. 无序多分类资料
E. 有序多分类资料

正确答案：C。二分类资料